关于蛋白质的特点，错误的是
A. 是人体组织的构成成分
B. 供给能量
C. 仅由碳、氢、氧组成
D. 构成体内各种重要的生理活性物质
E. 体内蛋白质处于分解、合成的动态平衡之中

正确答案：C。仅由碳、氢、氧组成